良性肿瘤的治疗应以什么治疗为主
A. 手术治疗
B. 放射治疗
C. 化疗
D. 中医中药治疗
E. 伽马刀治疗

正确答案：A。手术治疗

解析：本题考查良性肿瘤的治疗。口腔颌面部肿瘤按其生物学特性和对人体的危害可分为良性和恶性两大类。良性肿瘤的治疗应以手术治疗为主（A对）。恶性肿瘤应根据肿瘤的组织来源、生长部位、分化程度、发展速度、临床分期、患者机体状况等全面研究后再选择适当的治疗方法。通常包括手术、放疗（B错）包括伽马刀治疗（E错）、化疗（C错）、生物治疗包括中医中药治疗（D错）、低温治疗、激光治疗、高温治疗、营养治疗、综合序列治疗。